无偿献血的血液用途，应符合以下哪项规定
A. 由血站自主决定
B. 在保证临床用血的前提下，可以出售给血液制品生产单位
C. 在保证临床用血的前提下，可以出售给单采血浆站
D. 必须用于临床
E. 由卫生行政部门根据情况确定

正确答案：D。必须用于临床

解析：本题考查无偿献血的血液用途。无偿献血的血液用途，必须用于临床（D对AE错），不得买卖。血站、医疗机构不得将无偿献血的血液出售给单采血浆站（C错）或者血液制品生产单位（B错）。